关于磺酰脲类降糖药的分类及临床应用的说法，正确的有
A. 格列吡嗪、格列本脲为第一代磺酰脲类药物
B. 最常见的不良反应为低血糖
C. 禁用于1型糖尿病患者
D. 轻、中度肾功能不全者可选用格列喹酮
E. 可用于控制应激状态如发热、感染和外科手术时的高血糖

正确答案：B、C、D。最常见的不良反应为低血糖；禁用于1型糖尿病患者；轻、中度肾功能不全者可选用格列喹酮

解析：本题考查磺酰脲类降糖药的分类及临床应用。磺酰脲类药物最常见的不良反应为低血糖（B对）。磺酰脲类药物禁用于1型糖尿病（C对）、糖尿病低血糖昏迷、酮症酸中毒者；严重的肾或肝功能不全者、晚期尿毒症者。对轻、中度肾功能不全者，宜选用格列喹酮（D对）。格列吡嗪、格列本脲、格列齐特及格列美脲是第二代磺酰脲类药物（A错）。应激状态如发热、昏迷、感染和外科手术时，口服降糖药必须换胰岛素治疗（E错）。